戴全口义齿感到下颌牙槽嵴普遍疼痛或压痛，面颊部肌肉酸痛，上腭部有烧灼感，是由于
A. 排牙不准确
B. 下颌前伸
C. 下颌后退
D. 垂直距离过低
E. 垂直距离过高

正确答案：E。垂直距离过高

解析：本题考查垂直距离恢复得过高的表现。戴全口义齿感到下颌牙槽嵴普遍疼痛或压痛，面颊部肌肉酸痛，上腭部有烧灼感，是由于垂直距离过高（E对）。垂直距离恢复得过高：表现为面部下1/3距离增大，上下唇张开、勉强闭合上下唇时，颏唇沟变浅，肌肉张力增加，黏膜压痛，咀嚼费力，容易出现肌肉疲劳感。人工牙排列位置不正确可造成义齿不稳定（A错）。下颌前伸、后退会导致颞下颌关节酸胀不适（BC错）。垂直距离过低会导致面下1/3距离变小，口角下垂，颏部前突，息止（牙合）间隙变大（D错），咀嚼无力，咀嚼效率低。